慢性肺心病患者，呼吸浅短，声低气怯，张口抬肩，倚息不能平卧，心慌，形寒，汗出，舌淡紫，脉沉细微无力。治疗首选
A. 越婢加半夏汤
B. 生脉散合血府逐瘀汤
C. 真武汤
D. 苏子降气汤
E. 补肺汤

正确答案：E。补肺汤

解析：慢性肺心病，呼吸浅短，病位在肺肾；声低气怯，为气虚证的表现；张口抬肩，倚息不能平卧，为肾不纳气所致；心慌，形寒，汗出，舌淡紫，脉沉细微无力，辩证为肺肾气虚证；治宜补肺纳肾，降气平喘；宜用补益肺气，止咳平喘的补肺汤（E对）。越婢加半夏汤清热化痰，降逆平喘，为慢性肺心病急性加重期痰热郁肺证的代表方（A错）。生脉散合血府逐瘀汤功用益气活血，止咳化痰，为慢性肺心病缓解期气虚血瘀证的代表方（B错）。真武汤温肾健脾，与五苓散相合，可用于慢性肺心病急性加重期阳虚水泛证（C错）。苏子降气汤健脾益肺，化痰降气，是慢性肺心病急性加重期痰浊壅肺证的代表方（D错）。